可引起微管相关性神经毒性的药物是
A. 红霉素
B. 紫杉醇
C. 吗啡
D. 氯丙嗪
E. 可乐定

正确答案：B。紫杉醇

解析：本题考查抗肿瘤药。紫杉烷类抗肿瘤药物主要作用于聚合态的微管，可促进微管形成并抑制微管解聚，导致细胞在有丝分裂时不能形成纺锤体和纺锤丝，紫杉烷类常用药物为紫杉醇（B对）。